在21个国家中，调查了1950年至1960年和1960年至1970年的心脏病死亡率，并分析了心脏病与该国家1971年口服避孕药使用情况的关系。校正这些国家的年龄差别后，表明口服避孕药越多的国家心脏病死亡率越高。该研究可能是
A. 病例对照研究
B. 生态学研究
C. 回顾性定群研究
D. 定群研究
E. 上述答案都不是

正确答案：B。生态学研究